下列有关取模方法中一步法取印模说法错误的是
A. 简便易行
B. 节约时间
C. 印模准确
D. 技术要求低
E. 就位一次制取出印模

正确答案：D。技术要求低

解析：一步法取印模简便易行、节约时间，获得印模准确，但技术要求髙。掌握“暂时冠及印模与模型”知识点。